封闭垂体窝的是
A. 小脑幕
B. 大脑镰
C. 小脑镰
D. 鞍膈
E. 硬脑膜窦

正确答案：D。鞍膈

解析：垂体为一灰红色的椭圆形小体，位于颅底蝶鞍的垂体窝内，而垂体窝由鞍膈（D对）封闭。